关于胸膜腔的概念，正确的是
A. 胸膜腔即胸腔
B. 左、右胸膜腔互相交通
C. 肺位于胸膜腔内
D. 胸膜腔由脏胸膜与壁胸膜围成
E. 胸膜腔内含有大量浆液

正确答案：D。胸膜腔由脏胸膜与壁胸膜围成

解析：胸膜腔是由肺表面的脏层胸膜和胸廓的壁层胸膜构成（D对），而胸腔（A错）是由胸廓和膈肌围成，其中肺组织位于胸腔内（C错）。左右胸膜腔由纵膈分开，不能互相交通（B错）。胸膜腔内含有少量的浆液（E错），浆液分子间的内聚力使两层胸膜紧贴在一起，不易分开，参与胸膜腔负压的形成；这层浆液也可在两层胸膜之间起润滑的作用。